《药品经营质量管理规范实施细则》规定，药品批发和零售连锁企业的退货记录应保存
A. 1年
B. 2年
C. 3年
D. 4年
E. 5年

正确答案：E。5年

解析：本题考查退货记录保存期限。药品批发和零售连锁企业的退货记录应保存5年。企业应当制定药品采购、收货、验收、储存、养护、销售、出库复核、运输等环节及计算机系统的操作规程。企业应当建立药品采购、验收、养护、销售、出库复核、销后退回和购进退出、运输、储运温湿度监测、不合格药品处理等相关记录，做到真实、完整、准确、有效和可追溯。书面记录及凭证应当及时填写，并做到字迹清晰，不得随意涂改，不得撕毁。更改记录的，应当注明理由、日期并签名，保持原有信息清晰可辨。记录及凭证应当至少保存5年。疫苗、特殊管理的药品的记录及凭证按相关规定保存。